决定固定义齿基牙数目的因素中错误的是
A. 基牙牙槽骨的高度
B. 基牙牙周膜面积
C. 缺隙的长度
D. 咬合力大小
E. 牙槽嵴丰满度

正确答案：E。牙槽嵴丰满度

解析：固定义齿缺牙数目选择因素为：①依据牙周膜面积来确定基牙数量；②被选作基牙的牙槽骨结构正常，没有吸收或者吸收不超过根长的1/3；③若缺失牙在两个以上，且为间隔缺失，中间基牙增加支持；④在上述条件均符合，如果缺隙较长，缺牙区咬合力不大时，可以考虑固定义齿修复。掌握“固定桥的生理基础”知识点。